下列评价指标中属于近期或中期效果评价指标的是
A. 卫生知识知晓率
B. 平均期望寿命
C. 发病率
D. 婴儿死亡率
E. ASHA指数

正确答案：A。卫生知识知晓率